下列属于青少年健康监测功能指标的是
A. 身高
B. 体重
C. 肺活量
D. 50米跑
E. 引体向上

正确答案：C。肺活量